男，56岁。饮酒史30余年。20年前下岗后饮酒逐渐增加，每天白酒1斤，从未间断。进食少，体型消瘦。能间断外出打零工，生活基本正常。10年前常无故怀疑妻子有外遇。近2年记忆力明显下降，易忘事。4天前患者被摩托车撞伤致轻微骨折，住院拟行手术治疗，故停酒3天。昨晚患者看见地板上有各种虫子在爬，大喊大叫称床底下着火了，紧张害怕。不认识爱人，不知道自己在什么地方。该患者目前处于
A. 妄想状态
B. 谵妄状态
C. 躁狂状态
D. 幻觉状态
E. 痴呆状态

正确答案：B。谵妄状态

解析：中年男性患者，急性起病、意识障碍、定向障碍、伴波动性认知功能损害，综合患者的症状、体征，该患者目前处于谵妄状态（B对）。妄想状态（A错）无意识障碍、定向障碍等明显的功能障碍。躁狂状态（C错）多表现为情感高涨、思维奔逸及动作增多。幻觉状态（D错）多无定向障碍及认知功能损害。痴呆状态（E错）以缓慢出现的智能减退为主要特征，常有人格改变。